女，40岁。咳嗽2周，心前区锐痛2天，深呼吸时加重，放射到颈部。查体：胸部无压痛。心界不大，胸骨左缘第3、4肋间可闻及抓刮样粗糙音，屏气后仍存在。该患者最可能的诊断是
A. 急性胸膜炎
B. 急性心包炎
C. 急性肋软骨炎
D. 急性心肌梗死
E. 急性心肌炎

正确答案：B。急性心包炎

解析：患者中年女性，咳嗽2周（提示有感染病史），现心前区锐痛，深呼吸时加重，放射到颈部（急性心包炎的典型胸痛特点），查体：胸骨左缘第3、4肋间可闻及抓刮样粗糙音（急性心包炎的特异性体征），屏气后仍存在（提示非胸膜杂音），因此该患者最可能的诊断是急性心包炎（B对）。急性胸膜炎（A错）表现为胸痛，由于呼吸时胸膜的摩擦，胸痛呈吸气明显，屏气消失的特点；急性肋软骨炎（C错）常表现为局部肋软骨轻度肿大隆起，表面光滑，皮肤正常，局部压痛；急性心肌梗死（D错）发病年龄较大，常有心绞痛或心肌梗死病史，疼痛性质与呼吸运动无关；急性心肌炎（P270）（E错）可见心界扩大，其体征一般以心律失常为主，临床症状可有心悸、呼吸困难、水肿，甚至晕厥、猝死，而且这四种疾病均不会在胸骨左缘第3、4肋间闻及抓刮样粗糙音。